β受体阻断剂对心血管系统的作用不包括
A. 心率减慢
B. 血压猛升
C. 心肌收缩力减弱
D. 心输出量减少
E. 心肌耗氧量下降

正确答案：B。血压猛升

解析：β受体阻断剂对心血管系统的作用：当心脏交感神经张力增高时，阻断β受体对心脏的抑制作用明显，主要表现为心率减慢，心肌收缩力减弱，心输出量减少，心肌耗氧量下降，血压略降。掌握“β肾上腺素受体阻断剂”知识点。